黄芪具有补气升阳的作用，组方中含黄芪的中成药有
A. 补中益气丸
B. 八珍颗粒
C. 人参归脾丸
D. 生脉饮
E. 当归补血口服液

正确答案：A、C、E。补中益气丸；人参归脾丸；当归补血口服液

解析：本题考查当归补血口服液、补中益气丸、人参归脾丸的药物组成。黄芪具有补气升阳的作用，组方中含黄芪的中成药有补中益气丸（A对）、人参归脾丸（C对）、当归补血口服液（E对）。补中益气丸（口服液、合剂、颗粒）【药物组成】黄芪（炙）、党参、白术（炒）、甘草（炙）、当归、陈皮、升麻、柴胡、大枣、生姜。人参归脾丸【药物组成】人参、黄芪（炙）、当归、龙眼肉、白术（麸炒）、茯苓、远志（去心、甘草炙）、酸枣仁（炒）、木香、甘草（炙）。当归补血口服液（丸、胶囊）【药物组成】黄芪、当归。八珍颗粒（B错）（丸）【药物组成】熟地黄、党参、当归、白芍（炒）、白术（炒）、茯苓、川芎、甘草（炙）。生脉饮（D错）（胶囊）【药物组成】红参、麦冬、五味子。